女性，45岁。肢体软弱无力，夜尿多2年余，今晨起双下肢不能活动，查体：血压170/100mmHg，均匀性轻度肥胖，双下肢松弛性瘫痪，血钾2.4mmol/L，最可能的诊断是
A. 原发性高血压
B. 嗜铬细胞瘤
C. 肾性高血压
D. 原发性醛固酮增多症
E. 库欣病

正确答案：D。原发性醛固酮增多症

解析：中年女性患者，出现肢体无力、双下肢松弛性瘫痪等神经肌肉症状、夜尿增多、血压升高（原发性醛固酮增多症的典型症状），血钾降低至2.4mmol/L（正常值3.5～5.5mmol/L），考虑诊断为原发性醛固酮增多症（D对）。原发性高血压（A错）主要是以体循环动脉压升高为主要临床表现的心血管综合征，虽有血压升高的表现，但进展缓慢，常见症状有头晕、头痛、颈项板紧、疲劳、心悸等，一般无低钾血症及肌无力症状。嗜铬细胞瘤（B错）以阵发性高血压为特征性表现，低钾血症较少见。肾性高血压（C错）往往在发现血压升高时已有蛋白尿、血尿和贫血、肾小球滤过功能减退、肌酐清除率下降，一般无低钾血症，肾功能持续减退可出现高钾血症。库欣病（E错）典型表现为向心性肥胖、满月脸、多血质、紫纹等，可出现高血压，但低钾血症不显著，明显的低血钾性碱中毒主要见于肾上腺皮质癌和异位ACTH综合征（P699）。